精子产生的部位
A. 睾丸纵隔
B. 睾丸小隔
C. 精曲小管
D. 精直小管
E. 睾丸网

正确答案：C。精曲小管

解析：精子由精曲小管（C对）的生精上皮产生。